男，36岁。因体表烧伤入院，估计深Ⅱ度面积为15%，Ⅲ度面积为25%。根据上述病情对该患者诊治有决定意义的检查是
A. 血培养
B. 脓培养
C. 血氨测定
D. 测尿比重
E. 骨髓检查

正确答案：A。血培养